西咪替丁治疗消化性溃疡病的机制是
A. 抑制胃壁细胞H⁺泵
B. 阻断H₂受体
C. 中和胃酸
D. 抗幽门螺杆菌
E. 阻断M1胆碱受体

正确答案：B。阻断H₂受体

解析：H₂受体阻断药能选择性阻断壁细胞H₂受体，拮抗组胺引起的胃酸分泌。不仅能抑制基础胃酸分泌，对促胃液素、咖啡因、进食和刺激迷走神经等引起的胃酸分泌均有抑制作用，主要用于消化性溃疡、胃肠道出血、胃酸分泌过多症和食管炎等。常用药物有西咪替丁等（B对）。